应用维生素K₁可以解救
A. 香豆素类中毒
B. 茚满二酮类中毒
C. 硫脲类中毒
D. 有机磷类中毒
E. 一氧化碳中毒

正确答案：A、B。香豆素类中毒；茚满二酮类中毒

解析：本题考查香豆素类杀鼠药中毒解救。应用维生素K₁可以解救香豆素类中毒（A对）和茚满二酮类中毒（B对）。香豆素类和茚满二酮类中毒时的特效解毒剂为维生素K₁，可静脉滴注维生素K₁，10～30mg，一日1～3次；亦可先静脉注射维生素K₁，50mg，然后改为10～20mg肌内注射，一日1～4次。严重出血时每日总量可用至300mg。硫脲类中毒（C错）用1：2000高锰酸钾溶液洗胃，口服硫酸镁30g导泻。有机磷类中毒（D错）的解毒剂为阿托品、碘解磷定、氯解磷定。一氧化碳中毒（E错）的特殊解毒剂为谷胱甘肽。